根据药典、局颁标准或其他规定的处方，将原料药物加工制成具有一定规格的药物制品，称为
A. 剂型
B. 中成药
C. 非处方药
D. 制剂
E. 新药

正确答案：D。制剂